根据充分病因-组分病因模型，若X是某疾病的病因之一，但即使是未暴露于它的人也会发病，说明X肯定
A. 是充分病因
B. 是必要病因
C. 是非必要非充分病因
D. 不是充分病因
E. 不是必要病因

正确答案：E。不是必要病因

解析：本题考查充分病因-组分病因模型的相关内容。根据必要病因的定义可知，若该病因不存在，疾病就不会发生，因此所有病人都具有该病因。本题中若X是某疾病的病因之一，但即使是未暴露于它的人也会发病，说明X肯定不是必要病因（E对ABCD错）。